医疗纠纷的解决途径不包括
A. 双方自愿协商
B. 申请人民调解
C. 申请行政调解
D. 向人民法院提起诉讼
E. 有关病历资料、现场实物封存和启封

正确答案：E。有关病历资料、现场实物封存和启封

解析：发生医疗纠纷，医患双方可以通过下列途径解决：①双方自愿协商；②申请人民调解；③申请行政调解；④向人民法院提起诉讼；⑤法律、法规规定的其他途径。而有关病历资料、现场实物封存和启封，则是发生医疗纠纷时，医疗机构应当告知患者或者近亲属的内容。